《药品经营许可证管理办法》规定，药品经营企业经营范围包括
A. 麻醉药品、精神药品、医疗用毒性药品
B. 生物制品
C. 放射性药品
D. 中药材、中药饮片、中成药、化学原料药及其制剂
E. 抗生素原料药及其制剂

正确答案：A、B、D、E。麻醉药品、精神药品、医疗用毒性药品；生物制品；中药材、中药饮片、中成药、化学原料药及其制剂；抗生素原料药及其制剂

解析：本题考查的是药品经营范围。《药品经营许可证管理办法》规定，药品经营企业经营范围包括麻醉药品、精神药品、医疗用毒性药品（A对）；生物制品（B对）；中药材、中药饮片、中成药、化学原料药及其制剂（D对）；抗生素原料药及其制剂（E对）。药品经营范围：药品经营范围包括：麻醉药品、第一类精神药品、第二类精神药品、药品类易制毒化学品、医疗用毒性药品、生物制品、药品类体外诊断试剂、中药饮片、中成药、化学药。其中，麻醉药品、精神药品、药品类易制毒化学品、医疗用毒性药品等经营范围的核定，按照国家有关规定执行；经营冷藏、冷冻药品或者蛋白同化制剂、肽类激素的，还应当在《药品经营许可证》经营范围项下予以明确。麻醉药品、第一类精神药品、药品类易制毒化学品及蛋白同化制剂、胰岛素外的肽类激素等不得列入药品零售企业持有的药品经营许可证的经营范围内。